2003年WHO/FAO联合专家委员会在报告中将膳食、营养和慢性病关系的科学证据划分的等级数量为
A. 3个
B. 4个
C. 5个
D. 7个
E. 9个

正确答案：B。4个

解析：本题考查2003年WHO/FAO联合专家委员会在报告中将膳食、营养和慢性病关系的科学证据划分的等级数量。2003年WHO/FAO联合专家委员会在报告中采用了世界癌症研究基金会的标准，将膳食、营养和慢性病关系的科学证据划分为确信的证据、很可能的证据、可能的证据、不充分的证据四个（B对ACDE错）不同的等级。